患儿，6岁。双侧腮腺漫肿已5天。近日热退腮肿渐消退，现又出现睾丸肿痛，痛引睾腹，治疗应首选方剂是
A. 银翘散
B. 导赤散
C. 温胆汤
D. 龙胆泻肝汤
E. 丹栀逍遥丸

正确答案：D。龙胆泻肝汤

解析：患儿双侧腮腺漫肿已5天近日热退腮肿渐消退，现又出现睾丸肿痛，痛引睾腹，属毒窜睾腹证，足厥阴肝经循少腹络阴器，邪毒内传，由少阳经脉传于厥阴经脉，引睾窜腹，可见睾丸肿痛，或少腹疼痛，治疗应首选方剂是龙胆泻肝汤（D对）。银翘散用于风热感冒，发热头痛，口干咳嗽，咽喉疼痛，小便短赤（A错）。导赤散主治心经火热证（B错）。温胆汤主治胆郁痰扰证（C错）。丹栀逍遥丸用于肝郁化火，胸胁胀痛，烦闷急躁，颊赤口干，食欲不振或有潮热，以及妇女月经先期，经行不畅，乳房与少腹胀痛（E错）。